提示室性心动过速的特征性心电图改变是
A. QRS波群电交替
B. 室性融合波
C. P波与QRS波群传导比例为1：2
D. QRS波群至逆传P波的时间≤0.10秒
E. 心动过速由房性期前收缩诱发

正确答案：B。室性融合波

解析：室性融合波是室性心动过速的特征性心电图改变（B对），其他表现还包括心室夺获、室房分离、全部心前区导联QRS波主波方向呈同向性。电交替现象是指来自同一起搏点的心搏，其心电图波形或振幅每搏呈交替性变化，最常见的为QRS波群电交替，而P波、T波等电交替较少见。QRS波群电交替（A错）见于心包炎、心包填塞、心肌病变等，也可见于室性心动过速，不具有特异性。室性心动过速会出现室房分离，即心房独立活动与QRS波无固定关系，但并没有固定的传导比例（C错）。心动过速由房性期前收缩诱发（E错）是阵发性室上性心动过速（P192）的心电图表现，可用于室速和室上性心动过速伴室内差异性传导的鉴别。查阅众多资料均未找到关于QRS波群至逆转P波时间的知识点。